男性，47岁。浮肿伴腰痛5年，血压160/100mmHg，蛋白尿（﹢﹢﹢），血浆蛋白25g/L。最可能的疾病是
A. 性肾炎普通型
B. 慢性肾炎高血压型
C. 慢性肾炎急性发作型
D. 慢性肾炎肾病型
E. 肾病综合征

正确答案：B。慢性肾炎高血压型

解析：患者浮肿伴腰痛5年，血压升高，蛋白尿阳性，血浆蛋白降低，符合慢性肾炎的诊断标准，患者以高血压为首发症状，血压升高可呈持续性，亦可呈间歇性，以舒张压升高为特点，有的患者血压呈持续性中等以上程度升高，故可诊断为慢性肾炎高血压型（B对ACDE错）。